能够裂解C4b的因子是
A. C3bB
B. CR
C. Ⅰ因子
D. C4b2a
E. C5b6789n

正确答案：C。Ⅰ因子